使用过量而致出血可用维生素K治疗的药物是
A. 华法林
B. 肝素
C. 链激酶
D. 维生素B₁₂
E. 双嘧达莫

正确答案：A。华法林

解析：本题考查华法林。维生素K可用于华法林（A对）过量所致的出血。华法林能竞争性抑制维生素K环氧化物还原酶，过量时可用维生素K解救。肝素（B错）使用过量所致的出血用鱼精蛋白对抗。链激酶（C错）引起的出血可用氨基己酸等抗纤溶药注射止血。维生素B₁₂（D错）适用于巨幼红细胞性贫血、神经炎、口炎性腹泻等一系列疾病。双嘧达莫（E错）主要用于缺血性心脏病、血栓栓塞性疾病、心肌缺血的诊断实验。